2，3位无双键，3位没有羟基的黄酮类化合物是
A. 黄酮醇
B. 二氢黄酮
C. 二氢黄酮醇
D. 异黄酮
E. 查耳酮

正确答案：B。二氢黄酮

解析：本题考查的是黄酮类化合物的主要结构类型。2，3位无双键，3位没有羟基的黄酮类化合物是二氢黄酮（B对）。二氢黄酮类的2-，3-位无双键，3-位无羟基。黄酮醇（A错）类的2-，3-位有双键，3-位有羟基。二氢黄酮醇（C错）类的2-，3-位无双键，3-位有羟基。异黄酮（D错）类的2-，3-位有双键，3-位有B-环。查耳酮（E错）类的三碳链不成环。